对以腹泻为主要症状的肠易激综合征者宜选用
A. 胰酶
B. 山莨菪碱
C. 双歧三联活菌制剂
D. 匹维溴铵
E. 左氧氟沙星

正确答案：D。匹维溴铵